出现口角下垂，上下睑不能闭合等面瘫症状。面神经的损伤部位位于
A. 膝状神经节
B. 鼓索与镫骨肌神经节之间
C. 脑桥与膝状神经节之间
D. 镫骨肌与膝状神经节
E. 茎乳孔以外

正确答案：E。茎乳孔以外

解析：根据味觉、听觉及泪液检查结果，还可明确面神经损害部位，从而作出相应的损害定位诊断。茎乳孔以外：面瘫。掌握“面神经麻痹”知识点。